化脓性细菌侵入血流引起的症状伴有多发性脓肿称为
A. 败血症
B. 毒血症
C. 菌血症
D. 脓毒血症
E. 病毒血症

正确答案：D。脓毒血症

解析：脓毒血症是指化脓性病菌侵入血流后，在其中大量繁殖，并通过血流扩散至宿主体内的其他组织或器官，形成多发转移性脓肿（D对）。败血症（A错）是指致病菌侵入血流后，并在其中大量生长繁殖并产生毒性产物，而引起全身性中毒症状（P80）。毒血症（B错）是指致病菌侵入宿主体内后，只在机体局部生长繁殖，病菌不进入血液循环，但其产生的外毒素入血（P79）。菌血症（C错）是指致病菌由局部侵入血流，但未在血流中生长繁殖，只是短暂的一过性通过血液循环到达体内适宜部位后在进行繁殖而致病（P80）。病毒血症（E错）是病毒进入人体后首先进入血液导致的，八版医学微生物学未涉及此概念。